足月新生儿病理性黄疸特点，错误的是
A. 血清总胆红素>221umol/L
B. 生后24小时出现黄疸
C. 黄疸持续时间>2周
D. 黄疸退而复现
E. 血清结合胆红素<34umol/L

正确答案：E。血清结合胆红素<34umol/L

解析：病理性黄疸其特点为①生后24小时内出现黄疸（B对）；②血清总胆红素值已达到相应日龄及相应危险因素下的光疗干预标准，或每日上升超过85μmol/L（5㎎/dl），或每小时＞8.5μmol/L（0.5㎎/dl）；③黄疸持续时间长，足月儿＞2周，早产儿＞4周；④黄疸退而复现（D对）；⑤血清结合胆红素＞34μmol/L（E错，为本题正确答案）。足月新生儿血清总胆红素＜221μmol/L是生理性的，足月新生儿病理性黄疸血清总胆红素＞221μmol/L（A对），黄疸持续时间＞2周（C对），黄疸退而复现，血清结合胆红素＞34μmol/，故血清结合胆红素<34umol/L（E错，为本题正确答案）。